组织制定和公布直接接触药品的包装材料和容器的药用要求与标准的部门是
A. 市（地）级药品监督管理机构
B. 国家市场监督管理部门
C. 省级药品监督管理部门
D. 省（区、市）市场监督管理部门
E. 国家药品监督管理局

正确答案：E。国家药品监督管理局

解析：本题考查药品包装的管理。组织制定和公布直接接触药品的包装材料和容器的药用要求与标准的部门是国家药品监督管理局（E对）。《中华人民共和国药品管理法实施条例》第六章药品包装的管理第四十三条：药品生产企业使用的直接接触药品的包装材料和容器，必须符合药用要求和保障人体健康、安全的标准。直接接触药品的包装材料和容器的管理办法、产品目录和药用要求与标准，由国务院药品监督管理部门组织制定并公布。第四十四条：生产中药饮片，应当选用与药品性质相适应的包装材料和容器；包装不符合规定的中药饮片，不得销售。中药饮片包装必须印有或者贴有标签。中药饮片的标签必须注明品名、规格、产地、生产企业、产品批号、生产日期，实施批准文号管理的中药饮片还必须注明药品批准文号。第四十五条：药品包装、标签、说明书必须依照《药品管理法》第五十四条和国务院药品监督管理部门的规定印制。药品商品名称应当符合国务院药品监督管理部门的规定。第四十六条：医疗机构配制制剂所使用的直接接触药品的包装材料和容器、制剂的标签和说明书应当符合《药品管理法》第六章和本条例的有关规定，并经省、自治区、直辖市人民政府药品监督管理部门（C错）批准。